疾病临床诊断过程中，医生在体格检查过程中应遵循的伦理要求是
A. 全面系统，认真细致
B. 耐心倾听，正确诱导
C. 全神贯注，语言得当
D. 严谨求实，防止差错
E. 精心管理，保证安全

正确答案：A。全面系统，认真细致

解析：在体格检查中，医生应遵循以下伦理要求：（一）全面系统，认真细致；（二）关心体贴，减少痛苦；（三）尊重患者，心正无私。BC两项为询问病史中应遵循的伦理要求，DE两项为辅助检查过程中医技人员应遵循的伦理要求。掌握“临床诊疗和临床诊断的伦理”知识点。